石斛的功效是
A. 益胃生津
B. 补肝明目
C. 补阴益气
D. 壮阳健骨
E. 软坚散结

正确答案：A。益胃生津

解析：本题考查的是石斛的功效。石斛的功效是益胃生津（A对）。石斛：【功效】养胃生津，滋阴除热，明目，强腰。枸杞子：【功效】滋补肝肾，明目（B错），润肺。黄精：【功效】滋阴润肺，补脾益气（C错）。仙茅：【功效】补肾壮阳（D错），强筋健骨，祛寒除湿。鳖甲：【功效】滋阴潜阳，退热除蒸，软坚散结（E错）。